下列选项中属于生命质量评价主体的是
A. 病人
B. 测量者
C. 被测量者
D. 护士
E. 医生

正确答案：C。被测量者

解析：本题考查生命质量评价的主体。生命质量评价是主观的评价指标，应由被测者自己评价。所以其主体是被测量者（C对ABDE错）。